患儿，5岁。臀部及下肢紫癜1天，呈对称性，色鲜红，瘙痒，发热，舌红，苔薄黄，脉浮数。治疗应首选
A. 犀角地黄汤
B. 连翘败毒散
C. 归脾汤
D. 化斑汤
E. 大补阴丸

正确答案：B。连翘败毒散

解析：题中患儿臀部及下肢紫癜1天，故诊断为紫癜。发热，舌红，苔薄黄，脉浮数为风热之邪犯表，风热之邪外感，内窜血络而致紫癜，风热之邪为阳邪，故紫癜色鲜红，风善行而数变故瘙痒，故辨为风热伤络证，治宜疏风清热，宁血消癜。犀角地黄汤为紫癜血热妄行证的选方，功能清热解毒，凉血散瘀（A错）。连翘败毒散为紫癜风热伤络证的选方，功能疏散风邪，清热凉血（B对）。归脾汤为紫癜气不摄血证的选方，功能健脾养心，益气摄血（C错）。化斑汤可用于治疗紫癜血热妄行证，功能清气凉血（D错）。大补阴丸为紫癜阴虚火旺证的选方，功能滋阴降火（E错）。